在抗原抗体反应中，下述哪项错误
A. 抗原抗体特异性结合
B. 抗原抗体结合稳定、不可逆
C. 抗原抗体按一定比例结合
D. 反应受酸碱度影响
E. 反应受温度影响

正确答案：B。抗原抗体结合稳定、不可逆